有下列哪一种情形的属于劣药
A. 药品所含成分名称与国家药品标准规定不符合的
B. 超过有效期
C. 未取得批准文号生产的
D. 变质
E. 被污染

正确答案：B。超过有效期